原发性醛固酮增多症治疗用
A. 螺内酯
B. 酚苄明
C. 酮康唑
D. 米托坦
E. 美替拉酮

正确答案：A。螺内酯

解析：原发性醛固酮增多症患者血浆醛固酮增多导致潴钠、潴水及排钾，出现以高血压和低钾血症为特征的临床表现。螺内酯（A对）为醛固酮受体拮抗剂，可特异性拮抗醛固酮的作用，纠正低血钾，并减轻高血压，既可用于非手术的药物治疗，也可用于手术治疗的术前准备。酚苄明（B错）为长效α受体拮抗药，适用于嗜铬细胞瘤切除术的术前准备（P712）。酮康唑（C错）为系统性抗真菌药，亦可用于库欣综合征的治疗。米托坦（D错）用于无法手术的、功能性和非功能性肾上腺皮质癌、肾上腺皮质增生以及肿瘤所致的皮质醇增多症。美替拉酮（E错）通常用于库欣综合征的鉴别诊断及治疗。